组成药物中含有桂枝的方剂是
A. 乌梅丸
B. 芍药汤
C. 暖肝煎
D. 阳和汤
E. 地黄饮子

正确答案：A。乌梅丸

解析：该题考查方剂的组成，属记忆内容。乌梅丸【组成】乌梅  细辛  干姜  黄连  当归  附子  蜀椒  桂枝  人参  黄柏（A对）。趣记：贵妇人：当鬼脸，数百将——桂附人：当归连，蜀柏姜。